残髓炎最有价值的诊断指征是
A. X线片检查
B. 温度刺激测验
C. 电测验
D. 去原补物探查患牙根部深处有无感觉或疼痛
E. 叩诊

正确答案：D。去原补物探查患牙根部深处有无感觉或疼痛

解析：本题考查残髓炎的诊断指征。残髓炎属于慢性牙髓炎，发生在经牙髓治疗后的患牙，由于残留了少量炎症根髓或多根牙遗漏了有炎症牙髓的根管，故而命名为残髓炎。由于根管中有残留牙髓，探诊时会出现疼痛，所以可以通过去原补物探查患牙根部深处有无感觉或疼痛（D对），这是残髓炎最有价值的诊断指征。由于软组织不显影，牙髓属于软组织，所以X线片无明显变化，残髓炎不能用X线片检查（A错）。残髓炎温度刺激测验（B错）其反应可为迟缓性痛或仅诉有所感觉，而牙髓慢性炎症、牙髓变性或牙髓部分坏死均可表现为迟缓性痛，残髓炎不易与这些疾病鉴别。电测验（C错）只能检测出牙髓的死或活，残髓炎电活力无反应，当牙髓坏死和牙髓变性也会出现电活力测试无反应，残髓炎不易与这些疾病鉴别。残髓炎会出现叩诊（E错）轻微疼痛或不适感，慢性牙髓炎也会出现相同症状，二者不易鉴别。